胃火炽盛，消谷善饥，烦渴多饮者，治疗宜选用
A. 黄柏
B. 栀子
C. 黄连
D. 黄芩
E. 苦参

正确答案：C。黄连

解析：该题考查黄连的临床应用。胃火炽盛，消谷善饥，烦渴多饮者为胃火炽盛之消渴，治以清泻胃火，黄连入胃经，具有清热燥湿，泻火解毒的功效，善清胃火、治消渴（C对）。黄柏具有清热燥湿，泻火解毒，除骨蒸的功效，善泻相火、退骨蒸，用治阴虚火旺，潮热盗汗、腰酸遗精，没有清胃热之功（A错）。栀子具有泻火除烦，清热利湿，凉血解毒的功效，栀子泻心、肺、三焦之火，无清泻胃火之功（B错）。黄芩具有清热燥湿，泻火解毒，止血，安胎的功效，善清泻肺火及上焦实热，没有清泻胃火之功（D错）。苦参具有清热燥湿，杀虫，利尿，用治胃肠湿热，湿热带下，湿热小便不利，没有清泻胃火之功（E错）。